祛邪法适用于
A. 实证
B. 虚证
C. 虚中夹实
D. 虚实夹杂
E. 实中夹虚

正确答案：A。实证

解析：一般多用于外感病初期、极盛期或疾病过程中出现痰饮、水湿、瘀血等病理产物，而正气尚可耐受攻伐的状况（A对）；虚证采取扶正治则（B错）；虚中夹实采取以扶正为主，佐以祛邪的治则（C错）；虚实夹杂采取扶正、祛邪先后使用的治则（D错）；实中夹虚采取以祛邪为主，佐以扶正的治则（E错）。